患者，女，48岁。平时白带量多，终日不断，质稀清冷，腰膝酸冷，小腹发凉，小便清长，夜尿频多，舌淡苔薄白，脉沉迟。治疗应首选
A. 完带汤
B. 金匮肾气丸
C. 内补丸
D. 止带方
E. 易黄汤

正确答案：C。内补丸

解析：患者平时白带量多，终日不断，伴有腰膝酸冷，小腹发凉，小便清长，夜尿频多等肾阳虚的症状，是带下量多之肾阳虚证，治用内补丸以温肾培元，固涩止带（C对）。完带汤功效健脾益气，升阳除湿，多用于治疗带下过多脾虚证（A错）。金匮肾气丸温补肾阳，化气行水。用于肾虚水肿，腰膝酸软，小便不利，畏寒肢冷等症状（B错）。止带方功效清利湿热，佐以解毒杀虫，用于带下过多湿热下注证（D错）。易黄汤功效固肾止带，清热祛湿，用于肾虚湿热带下证（E错）。